以下哪项常伴有唇裂或腭裂
A. 腭裂
B. 上颌裂
C. 下颌裂
D. 上唇裂
E. 下唇裂

正确答案：B。上颌裂

解析：本题考查腭部与舌的发育。上颌裂（B对）为前腭突与上颌突未能联合或部分联合所致，常伴有唇裂或腭裂